男，45岁。因反复咳嗽一个月到社区卫生服务中心就诊。医生与其交谈中得知该患者已经吸烟20多年，3年前曾经尝试戒烟一个月并得到家人的支持和鼓励。但后来患者由于听说戒烟会生病等传闻而不再考虑戒烟。针对该患者的情况，根据提高患者戒烟动机的干预措施的“5R”法，此时医生应侧重于采用下列哪项措施进行干预
A. 建议改吸低焦油卷烟
B. 使患者认识到戒烟可能的障碍
C. 强调吸烟与其家人健康的相关性
D. 指出二手烟暴露的健康危害
E. 说明戒烟的益处

正确答案：E。说明戒烟的益处

解析：该患者听说戒烟会生病才停止戒烟，可见应该向他说明戒烟的益处（E对）才能促进他戒烟。“5R”法：指出相关性、强调危险性、认识回报、认清障碍、反复动员。强调吸烟与其家人健康的相关性（A错）属于指出相关性：使患者认识到戒烟可能的障碍（B错）属于帮助患者认清障碍：强调吸烟与其家人健康的相关性（C错）属于指出相关性。建议改吸低焦油卷烟（A错）并不属于干预措施的“5R”法。